可溶于水的生物碱
A. 薄荷油
B. 小檗碱
C. 莪术油
D. 穿心莲内酯
E. 东莨菪碱

正确答案：B。小檗碱

解析：本题考查生物碱的溶解性。可溶于水的生物碱小檗碱（B对）。生物碱的溶解性与生物碱分子结构中氮原子的存在状态、分子大小、分子中极性基团的种类和数目以及溶剂的种类有关。大多数生物碱的溶解性符合一般规律，也有一些生物碱的溶解性较特殊。亲水性生物碱：①季铵型生物碱②含N-氧化物结构的生物碱③小分子生物碱④酰胺类生物碱，小檗碱属于季铵碱。薄荷油（A错）中的主要成分薄荷醇的化学结构属于单环单萜类。莪术油（C错）中主要含有多种倍半萜类物质。穿心莲叶中含有多种二萜内酯及二萜内酯苷类成分，如穿心莲内酯、新穿心莲内酯（D错）等。东莨菪碱（E错）为莨菪烷型生物碱，常存在于茄科植物中。莨菪碱（或阿托品）亲脂性较强，易溶于乙醇、三氯甲烷，可溶于四氯化碳、苯，难溶于水。